下列辅料中，可作为滴丸剂水溶性基质的是
A. 硬脂酸
B. 单硬脂肪甘油酯
C. 凡士林
D. 泊洛沙姆
E. 羊毛脂

正确答案：D。泊洛沙姆

解析：本题考查滴丸剂的基质。泊洛沙姆（D对）为滴丸剂常用的水溶性基质，硬脂酸（A错）、单硬脂酸甘油酯（B错）、凡士林（C错）、羊毛脂（E错）均为滴丸剂常用的脂溶性基质。